现病史是指
A. 主要症状的特点
B. 病人就诊的主要原因
C. 疾病的原因与诱因
D. 疾病诊治经过
E. 该次得病的全部情况

正确答案：E。该次得病的全部情况

解析：现病史是病史中最重要的部分，也是主体部分，包括现在所患疾病的最初症状，自开始到就诊时的全过程，即发生、发展、演变和诊治的经过，是该次得病的全部情况（E对）。现病史一般记录与主诉相关的问题，回答什么、什么时间、如何、哪里、哪个、谁和为什么。主要症状的特点（A错）、病人就诊的主要原因（B错）属于主诉（主诉为患者感受到的最主要的痛苦或最明显的症状和（或）体征，也就是本次就诊最主要的原因及其持续时间）所要求的内容。疾病的原因与诱因（C错）、疾病诊治经过（D错）都是现病史中的内容。